不属于下颌阻生第三磨牙拔除术的适应证
A. 反复引起冠周炎症者
B. 引起第二磨牙牙体、牙周病变者
C. 可能为颞下颌关节紊乱病诱因者
D. 完全骨埋伏阻生
E. 正畸需要

正确答案：D。完全骨埋伏阻生

解析：本题考查阻生牙拔除术。完全骨埋伏阻生（D错，为本题正确答案）不属于下颌阻生第三磨牙拔除术的适应证。下颌阻生第三磨牙拔除术的适应证：反复引起冠周炎症者（A对）；本身有龋坏，或引起第二磨牙牙体、牙周病变者（B对）；因正畸需要（E对）时；可能为颞下颌关节紊乱病诱因者（C对）；因完全骨阻生而被疑为原因不明的神经痛病因者或可疑为病灶牙者；已引起牙源性囊肿或肿瘤；因压迫导致第二磨牙牙根中远中骨吸收；引起第二磨牙与第三磨牙直接食物嵌塞。